坐骨体与坐骨支汇合处粗糙的隆起称
A. 坐骨大切迹
B. 坐骨小切迹
C. 坐骨棘
D. 坐骨结节
E. 髂结节

正确答案：D。坐骨结节

解析：坐骨体与坐骨支汇合处粗糙的隆起称坐骨结节 （D对）。坐骨体组成髋臼的后下 2/5, 后缘有突起的坐骨棘（C错）, 棘下方为坐骨小切迹（B错），坐骨棘与骼后下棘之间为坐骨大切迹（A错）。髂前上棘后方 5 -7cm 处，髂嵴外唇向外突起，称髂结节 （E错）。